饮水占人体氟来源的
A. 0.55
B. 0.65
C. 0.75
D. 0.85
E. 0.95

正确答案：B。0.65

解析：人体氟的主要来源是饮水，约占人体氟来源的65%。掌握“人体氟摄入及代谢、氟防龋”知识点。